颊间隙感染的主要临床表现是
A. 下颌下、口底广泛性水肿
B. 以下颌角为中心的红肿
C. 先有牙痛史，继之出现张口受限
D. 面颊部弥漫性肿胀
E. 颞部有深压痛

正确答案：D。面颊部弥漫性肿胀

解析：颊间隙感染临床特点由于脓肿形成部位不同，在颊部皮下或黏膜下的脓肿，病程进展缓慢，肿胀及脓肿的范围较为局限。但感染波及颊脂垫时，病情发展迅速，肿胀范围波及整个颊部，并可向相邻间隙扩散，形成多间隙感染。掌握“下颌下间隙、颊间隙感染”知识点。